艾滋病期由于严重的细胞免疫缺陷，发生继发肿瘤，以下列哪项最为常见
A. 霍奇金病
B. 淋巴肉瘤
C. 卡波西肉瘤
D. 非霍奇金淋巴瘤
E. 皮肤恶性肿瘤

正确答案：C。卡波西肉瘤

解析：恶性肿瘤的发病率增加是艾滋病流行的显著特征，目前公认的有卡波西肉瘤（C对）、非霍奇金B细胞性淋巴瘤、霍奇金淋巴瘤（A错）、脑原发性恶性淋巴瘤和浸润性宫颈癌。其中卡波西肉瘤和非霍奇金B细胞性淋巴瘤占95%。淋巴肉瘤（B错）和皮肤恶性肿瘤（E错）属于卡波西肉瘤。非霍奇金B细胞性淋巴瘤仅为非霍奇金淋巴瘤（D错）的艾滋病相关的组织学类型。